男，68岁。急性前壁心肌梗死，为预防再梗和猝死，如无禁忌症，宜尽早使用的药物是
A. 硝苯地平
B. 阿托品
C. 美托洛尔
D. 地高辛
E. 美西律

正确答案：C。美托洛尔

解析：美托洛尔（C对）为选择性β₁受体拮抗剂，可降低心肌耗氧量，减少心肌缺血反复发作，减少复发性心肌缺血、再梗死等，对降低急性期病死率有肯定的疗效，常用于心肌梗死的预后和二级预防，故应尽早使用。硝苯地平（P244）（A错）属于二氢吡啶类钙通道阻滞剂，目前不推荐急性心肌梗死常规使用，仅在有β受体拮抗剂禁忌症时考虑使用。阿托品（B错）常用于急性心肌梗死导致的缓慢性心律失常。地高辛（D错）属于洋地黄类药物，主要用于慢性心力衰竭的强心治疗，当急性心肌梗死导致心力衰竭时，洋地黄因可能引起室性心律失常而慎用，需要注意的是心肌梗死发生后24小时内宜尽量避免使用洋地黄制剂（P244）。美西律（P206）（E错）属于抗心律失常药，常用于室性快速性心律失常，有一定减缓心率的作用，但对预防再梗和猝死无效果。